肺硅沉着症中，硅结节的叙述不正确的是
A. 早期为细胞性结节
B. 早期分布在肺组织内
C. 晚期为玻璃样变性结节
D. 其形成与患者从事的职业有关
E. 其形成与吸入的SiO₂颗粒大小和形状有关

正确答案：B。早期分布在肺组织内

解析：肺硅沉着病（简称硅肺）是长期吸入含游离二氧化硅（SiO₂）粉尘沉着于肺组织所引起的一种职业病（D对）。吸入的SiO₂颗粒大小和形状是致病的决定因素之一（E对），一般认为硅尘颗粒＞5μm时易附着于黏膜表面而被清除出体外，故不易致病；硅尘颗粒＜5μm时易进入肺内而致病，其中以1～2μm致病性最强。硅结节的形成是硅肺最具特征性的病变，早期的硅结节是由吞噬硅尘的巨细胞聚集形成的细胞性结节（A对），主要分布在肺门淋巴结（B错，为本题正确答案）；病情发展到晚期，硅结节内成纤维细胞增生，大量胶原纤维形成，部分结节内的胶原纤维可发生玻璃样变，形成玻璃样变性结节（C对）。